变异系数越大，说明
A. 标准差越大
B. 平均数越小
C. 平均数越大
D. 标准差和均数都大
E. 单位均数的变异越大

正确答案：E。单位均数的变异越大

解析：本题考查变异系数的相关内容。变异系数是一个度量相对离散程度的指标，是变异大小（标准差）相对于其平均水平（平均值）的百分比。变异系数值越大，表示变量的变异程度越大（E对ABCD错）。